分子中含有巯基，临床上可用于对乙酰氨基酚中毒解救的祛痰药物是
A. 右美沙芬
B. 磷酸可待因
C. 羧甲司坦
D. 盐酸氨溴索
E. 乙酰半胱氨酸

正确答案：E。乙酰半胱氨酸

解析：本题考查对乙酰氨基酚中毒解救药物。乙酰半胱氨酸（E对）为较强的黏液溶解剂，属于半胱氨酸的类似物，可通过巯基与毒性代谢产物N-乙酰亚胺醌结合使其失活，阻止其与肝细胞的大分子共价结合而解毒。右美沙芬（A错）和磷酸可待因（B错）为中枢性镇咳药。羧甲司坦（C错）为祛痰药，具有半胱氨酸的结构，但不具有游离的巯基，因此不能与毒性代谢产物结合而解毒。盐酸氨溴索（D错）为黏痰溶解剂，结构中不含游离的巯基，不能用于对乙酰氨基酚的中毒解救。